某工人从事矿工工作10年，出现手掌发汗、感觉麻木、冷水负荷试验皮温恢复时间延长、外周血管痉挛等表现，据此该工人接触的职业有害因素最可能为
A. 手传振动
B. 全身震动
C. 高温
D. 毒物
E. 高压

正确答案：A。手传振动